对B-1细胞描述错误的是
A. 出现较早
B. 不能自我更新
C. 表达CD5分子
D. 主要针对碳水化合物产生较强应答
E. 产生抗体无须Th细胞辅助

正确答案：B。不能自我更新